患者，男，54岁。咳嗽气粗，痰多痰黄，面赤身热，口干欲饮，舌红苔黄，脉滑数。其证候是
A. 痰热郁肺
B. 肺阴亏耗
C. 风燥伤肺
D. 风热犯肺
E. 风寒袭肺

正确答案：A。痰热郁肺

解析：题中患者以咳嗽气粗为主症，故诊断为咳嗽。痰壅热蒸，肺失清肃，气逆上冲，故咳嗽气粗；痰热互结，随肺气上逆，则痰多痰黄；里热炽盛，蒸达于外，则有面赤身热；热灼津伤，则口干欲饮；舌红苔黄，脉滑数均为痰热之象。故诊断为咳嗽痰热郁肺证（A对）。肺阴亏耗可见痰少黏白，或痰中带血，或口干咽燥，或午后潮热等症候，而不见痰多黏厚，胸胁胀满等症（B错）。风燥伤肺可见干咳，连声作呛，喉痒等症，而不见痰多黏厚，胸胁胀满等症（C错）。风热犯肺证属外感咳嗽，可见咳嗽频剧，咽燥咽痛，咳时汗出以及恶风，身热等表证，而题中患者属内伤咳嗽，不见外感表证（D错）。风寒袭肺证属外感咳嗽，可见咳嗽声重，气急，咽痒，咳痰稀薄色白，以及鼻塞，流清涕，头痛等表证，而不见痰多黏厚，胸胁胀满等症，且题中患者属内伤咳嗽，不见外感表证（E错）。